龋病在点隙窝沟，平滑面上表现为黄棕色色素沉着或者白垩色斑块，无明显龋洞，探针检查有粗糙感，一般没有主观症状的龋病是
A. 深龋
B. 中龋
C. 浅龋
D. 急性龋
E. 猖獗性龋

正确答案：C。浅龋

解析：浅龋一般无准确的量值，表现为点隙窝沟、平滑面上有黄棕色、黑褐色色素沉着或出现白垩色斑块，无明显龋洞，探针检查有粗糙感，患者一般无主观症状。掌握“牙釉质龋”知识点。